女，50岁。活动后胸闷1年，夜间阵发性呼吸困难4天。查体：BP130/80mmHg，P₂亢进，心尖部可闻及舒张期隆隆样杂音，余瓣膜区未闻及杂音。该患者突发心悸，伴胸闷、喘憋。查体：BP70/40mmHg，心率160次/分，心律绝对不齐。首选的治疗措施是
A. 置入临时起搏器
B. 静脉注射毛花苷丙
C. 静脉应用胺碘酮
D. 非同步直流电复律
E. 同步直流电复律

正确答案：E。同步直流电复律

解析：患者中年女性，活动后胸闷、夜间阵发性呼吸困难（提示左心衰竭），心尖区舒张中晚期低调的隆隆样杂音（二尖瓣狭窄特征性的杂音），考虑诊断为二尖瓣狭窄。患者现突发心悸，伴胸闷、喘憋，查体：BP70/40mmHg（正常值90～139/60～89，血压严重偏低，提示有休克症状），心率160次/分（正常值60～100次/分），心律绝对不齐（房颤典型体征），对于二尖瓣狭窄伴房颤且出现休克和血流动力学紊乱的患者，首选的治疗措施是同步直流电复律（E对）。置入临时起搏器（A错）多用于窦房结病变或重度传导阻滞导致心室率偏慢而引起明显临床症状的患者，如病态窦房结综合征（P184）和完全性房室传导阻滞（P203）等。毛花苷丙（B错）可降低房颤的心室率，但一般用于无休克症状和血流动力学紊乱的患者。胺碘酮（P190）（C错）在房颤患者的治疗中一般用于转复和维持窦性心律，并不能降低患者快速的心室率。非同步直流电复律（P208）（D错）临床上用于室颤，此时已无心动周期，也无QRS波，应即刻于任何时间放电。